左旋多巴可
A. 用于抗帕金森病
B. 引起短暂心动过速
C. 减少催乳素的分泌
D. 用于抗精神病
E. 用于镇吐

正确答案：A、B、C。用于抗帕金森病；引起短暂心动过速；减少催乳素的分泌